是卡环产生固位作用的部分，可防止义齿（牙合）向脱位的是
A. 基托
B. 卡环臂
C. 单个支托
D. 卡环体
E. （牙合）支托

正确答案：B。卡环臂

解析：卡环臂：为卡环的游离部分，富有弹性，环绕基牙。卡环臂尖位于倒凹区，是卡环产生固位作用的部分，可防止义齿（牙合）向脱位。卡环臂起始部分较坚硬，放置在观测线上或非倒凹区，起稳定作用，防止义齿侧向移位。掌握“局部义齿人工牙及基托”知识点。